患者，女性，30岁。月经量多，已2年，近3个月来感乏力、头晕、心悸，查：血红蛋白65g/L，白细胞6.0×10⁹/L，血小板140×10⁹/L。骨髓象：粒比红为1:1，红细胞增生活跃，中晚幼红细胞45％，体积小，胞质偏蓝，治疗首选
A. 肌注维生素B₁₂
B. 口服铁剂
C. 输血
D. 脾切除
E. 口服叶酸

正确答案：B。口服铁剂